关于人类胚胎干细胞研究的伦理原则不正确的是
A. 尊重原则
B. 知情同意原则
C. 安全和有效原则
D. 防止商品化原则
E. 保密原则

正确答案：E。保密原则

解析：我国国家人类基因组南方研究中心伦理学部起草的《人类成体干细胞研究和临床应用伦理准则（建议稿）》认为，人胚胎干细胞和成体干细胞研究以及临床试验都应遵循相关的伦理原则（A对）、知情同意原则（B对）、科学性原则、不伤害/受益原则（C对）、公正性原则、公益原则、非商业化原则（D对）（E错，为本题正确答案）。